有些化疗药物存在心脏毒性，在每个化疗周期前应该进行心电图或超声心动检查，排除心脏病变。下列化疗药物中，具有典型心脏毒性的是
A. 吉西他滨
B. 卡铂
C. 表柔比星
D. 奥沙利铂
E. 环磷酰胺

正确答案：C。表柔比星

解析：本题考查蒽环类抗肿瘤抗生素。具有典型心脏毒性的化疗药物是表柔比星（C对）。表柔比星为蒽环类抗肿瘤药，可致氧自由基形成，与其心脏毒性有关，表现为剂量累积性的心肌炎，引起迟发性严重心力衰竭，心电图呈室上性心动过速。吉西他滨（A错）为抗肿瘤药，用于治疗中、晚期非小细胞肺癌。吉西他滨主要副作用为血液系统不良反应，也就是骨髓抑制，可以导致贫血，白细胞降低以及血小板减少，没有典型心脏毒性。卡铂（B错）用于实体瘤如小细胞肺癌、卵巢癌、睾丸肿瘤、头颈部癌及恶性淋巴瘤等均有较好的疗效，也适用于其它肿瘤如子宫颈癌、膀胱癌及非小细胞性肺癌等。卡铂的主要不良反应有骨髓抑制，耳毒性，肾毒性，没有典型心脏毒性。奥沙利铂（D错）与5-氟尿嘧啶和亚叶酸（甲酰四氢叶酸）联合应用于转移性结直肠癌、原发肿瘤完全切除后的Ⅲ期结肠癌的治疗。奥沙利铂具有一定的血液毒性，没有典型心脏毒性。环磷酰胺（E错）用于恶性淋巴瘤、急性或慢性淋巴细胞白血病、多发性骨髓瘤，对乳腺癌、睾丸肿瘤、卵巢癌、肺癌、头颈部鳞癌、鼻咽癌、神经母细胞瘤、横纹肌肉瘤及骨肉瘤均有一定的疗效。环磷酰胺常见的不良反应有骨髓抑制，一般是在一到两周可以发生，然后三到五周就可以恢复，没有典型心脏毒性。